下列哪项不是痢疾的主要病理变化
A. 脾虚湿盛
B. 湿热壅滞肠中
C. 肠道传导失司
D. 气血壅滞肠中
E. 寒湿滞留肠中

正确答案：A。脾虚湿盛

解析：痢疾的主要病机是邪壅肠腑，气血壅滞（D对），传导失司（C对）。本病的病理性质分寒热虚实，病机演变多端。初期多实证，由湿热或寒湿所致（BE对）（A错，为本题正确答案）。